正常成年人安静时的肺通气/血流比值为
A. 0.048
B. 0.084
C. 0.24
D. 0.48
E. 0.84

正确答案：E。0.84